夹脊穴是指
A. 第一颈椎至第十二胸椎棘突下旁开0.5寸
B. 第七颈椎至第五腰椎棘突下旁开0.5寸
C. 第一胸椎至第五腰椎棘突下旁开0.5寸
D. 第一胸椎至第四腰椎棘突下旁开0.5寸
E. 第一胸椎至第十二胸椎棘突下旁开0.5寸

正确答案：C。第一胸椎至第五腰椎棘突下旁开0.5寸

解析：夹脊穴是经外奇穴，在脊柱区，第1胸椎至第5腰椎棘突下两侧，后正中线旁开0.5寸，一侧17穴（C对）。